某冶炼厂定期安排接铅工人到职业病院进行驱铅治疗和疗养，该工作应属于
A. 一级预防
B. 二级预防
C. 三级预防
D. 对症治疗
E. 支持疗法

正确答案：B。二级预防

解析：本题考查三级预防中的第二级预防。第二级预防（B对ACDE错）是早期检测和诊断人体受到职业性有害因素所致的健康损害并予以早期治疗、干预。其主要手段是定期进行职业性有害因素的监测和对接触者的定期体格检查，以早期发现病损和诊断疾病，特别是早期健康损害的发现，及时预防、处理。本题中接铅工人在未发病之前，定期进行的疗养属于二级预防的范畴。三级预防是指工人在患病后进行的疗养和治疗措施，与题意不符。